中成药中含格列本脲成分重复应用时，可致
A. 急性肾衰竭
B. 膀胱颈梗阻
C. 低血糖
D. 低血钾、低血压
E. 粒细胞减少

正确答案：C。低血糖

解析：本题考查重复用药。与含有格列本脲成分的中成药重复用药时，会使格列本脲服药过量，造成低血糖（C对）。格列本脲适用于单用饮食控制疗效不满意的轻、中度非胰岛素依赖型糖尿病，使用剂量不当，会产生严重的低血糖反应，特别是服用过量时，有致死的危险，应及时纠正。